女，26岁。月经规则，周期为28天，末次月经为4月1日，下列哪项是错误的
A. 排卵期约在4月15日
B. 若受孕，孕卵着床时间约在4月18日
C. B超下可能发现妊娠环的最早日期约在5月15日后
D. B超开始能观察到原始胎心搏动的时间在5月20日后
E. 预产期应在1月8日

正确答案：B。若受孕，孕卵着床时间约在4月18日

解析：本题考查妊娠生理。排卵期为4月15日，受精发生在排卵后12小时内，受精后第6～7日，晚期胚泡透明带消失后逐渐埋入并被子宫内膜覆盖的过程，称为受精卵着床。因此若受孕，孕卵着床时间约在4月18日（B错，为本题正确答案）错误。